阿片类药物按作用强度分为强阿片类和弱阿片类，下列药物中属于弱阿片类的药物是
A. 吗啡
B. 哌替啶
C. 羟考酮
D. 舒芬太尼
E. 可待因

正确答案：E。可待因

解析：本题考查阿片类镇痛药的分类。可待因（E对）属于弱阿片类药物。根据阿片类镇痛药的止痛强度，临床上将之分为弱、强阿片类药；吗啡（A错）、哌替啶（B错）、芬太尼（D错）均为强阿片类药；羟考酮（C错）为半合成阿片类药物。